月经血中不含有
A. 子宫内膜碎片
B. 宫颈黏液
C. 脱落的阴道上皮细胞
D. 血液
E. 毒素

正确答案：E。毒素

解析：本题考查月经血中含有的成分。月经血中不含有毒素（E错，为本题正确答案）。月经血是正常血液，是由女性的子宫内膜发生周期性脱落伴随的出血，不仅仅包含血液（D对），还包含一些其他成分，如子宫内膜碎片（A对）、宫颈黏液（B对）、脱落的阴道上皮细胞（C对）。